下唇与颏部之间的横形凹陷称为
A. 鼻面沟
B. 唇面沟
C. 颏唇沟
D. 鼻唇沟
E. 鼻小柱

正确答案：C。颏唇沟

解析：颏唇沟为下唇与颏部之间的横形凹陷。掌握“面部表面解剖”知识点。